关于Ig的描述，正确的是
A. 具有抗原性
B. IgD构成的免疫复合物可通过C1q激活补体
C. IgM中含分泌片
D. 有k和λ两类重链
E. 可被胃蛋白酶水解成Fab和Fc段

正确答案：A。具有抗原性

解析：抗原性又称免疫反应性是指抗原能与由它刺激所产生的免疫效应物质发生特异性结合的特性。Ig（免疫球蛋白）是血液和组织液中的一类糖蛋白，由B细胞接受抗原刺激后增殖分化生成的浆细胞产生，主要存在于血清等液体中，能与相应抗原特异地结合，具有抗原性（A对），是介导体液免疫的重要效应分子。有2个或2个以上的IgG、IgM分子与多价抗原形成的免疫复合物可通过C1q激活补体（B错）（P41）。分泌片（P31）（C错）是分泌型IgA分子上的辅助成分。轻链有κ和λ两种（D错）（P30）。抗体分子的铰链区可被木瓜蛋白酶水解成两个完全相同的Fab段和一个Fc段（E错）（P31）。